女，24岁，三天前无保护性行为，平时体健，无其他疾病，无过敏史。为防止意外怀孕，考虑选择
A. 注射抗生素
B. 进行早早孕检查
C. 口服避孕药
D. 注射大剂量抗生素
E. 口服葡萄糖

正确答案：C。口服避孕药

解析：生育年龄的健康妇女，使用口服避孕药是一种高效的避孕方法。掌握“激素避孕”知识点。